左下颌第三磨牙冠周炎并发面颊瘘的常见位置相当于左下颌
A. 第三磨牙
B. 第二磨牙
C. 第一磨牙
D. 第二前磨牙
E. 第一前磨牙

正确答案：C。第一磨牙

解析：本题考查智齿冠周炎。下颌智齿冠周炎的炎症可沿下颌骨外斜线向前扩散，在相当于下颌第一磨牙（C对）颊侧黏膜转折处的骨膜下形成脓肿，脓肿可破溃成瘘。由于沿下颌骨外斜线的走行，所以脓液不易在第三（A错）、第二磨牙（B错）位置的骨膜下聚集形成脓肿。